下列属于活体组织检查类型的是
A. 吸取活组织检查
B. 切除活组织检查
C. 冰冻活组织检查
D. 切取或钳取活组织检查
E. 以上都是

正确答案：E。以上都是

解析：活组织检查：是从病变部取一小块组织制成切片，在显微镜下观察细胞的形态和结构，以确定病变性质、肿瘤的类型及分化程度等。这是目前比较准确可靠的诊断方法。选项的几种方法都正确。掌握“口腔颌面部肿瘤的概念、临床表现、诊断”知识点。